男性，20岁，因阑尾炎穿孔行阑尾切除术后1周，体温仍在38～39℃，腹胀腹痛，尿频，大便次数多。首先考虑
A. 膈下脓肿
B. 肠间脓肿
C. 盆腔脓肿
D. 脾破裂
E. 胃十二指肠穿孔

正确答案：C。盆腔脓肿

解析：本例患者为青年男性，有因阑尾炎穿孔行阑尾切除术的病史，术后一周体温仍升高，维持在38～39℃，腹胀、腹痛，提示出现继发性感染，同时有尿频、大便次数增多等典型的直肠和膀胱刺激症状，诊断首先考虑为盆腔脓肿（C对）。膈下脓肿（A错）好发于胃十二指肠溃疡穿孔、胆囊与胆管化脓性感染等疾病，临床表现为发热、上腹部钝痛，X线透视可见患侧膈肌升高，随呼吸活动受限或消失，肋膈角模糊、积液等，不会出现尿频、大便次数增多等典型的直肠和膀胱刺激症状。肠间脓肿（B错）好发于克罗恩病等疾病，病人可出现化脓感染的症状，并有腹胀、腹痛、腹部压痛或扪及肿块，不会出现尿频等膀胱刺激症状。脾破裂（D错）患者多有外伤史，患者因大量出血可有面色苍白、脉率加快，严重时脉搏微弱，血压不稳，甚至休克等临床表现。胃十二指肠穿孔（E错）患者多有溃疡病史，临床表现为突发剧烈腹痛，腹膜刺激征阳性、X线检查常见膈下游离气体。